百白破疫苗初种年龄是
A. 2个月
B. 3个月
C. 8个月
D. 1个月
E. 生后2~3天

正确答案：B。3个月

解析：百白破疫苗初种年龄是3个月（B对）。麻疹疫苗初种年龄是8个月（C错）。2个月应该接种脊髓灰质炎（A错）。生后2～3天应接种乙肝卡介苗（E错）。